对合并同型半胱氨酸血症的高血压患者提倡联合应用
A. 阿司匹林
B. 叶酸
C. 阿托伐他汀
D. 呋塞米
E. 布地奈德

正确答案：B。叶酸

解析：本题考查降压药。伴同型半胱氨酸血升高的高血压者(H型高血压）适量补充叶酸（B对），可降低血浆同型半胱氨酸水平。阿司匹林（A错）用于合并血栓高危的高血压患者。阿托伐他汀（C错）用于合并缺血性心脏病的高血压患者。呋塞米（D错）用于高血压肾病患者。布地奈德（E错）用于哮喘的治疗。